患者，男性，28岁，农民。因在田间喷洒农药，突然晕倒在地，急诊入院。查体：血压135/94mmHg，语言不清，瞳孔缩小，对光反应消失，多汗，流涎，全身抽搐。对诊断最有意义的检查是
A. 肝、肾功能的测试
B. 全血胆碱酯酶活力的测定（ChE）为正常值的50%
C. 同时测定过氧化氢酶，过氧化物酶
D. 心电图检查
E. 血清总巯基的测定

正确答案：B。全血胆碱酯酶活力的测定（ChE）为正常值的50%